处方中缩写含义正确的有
A. 每日，qd.
B. 每日4次，qid.
C. 每4小时，q4h
D. 隔日一次，qnd.
E. 每晚，qn.

正确答案：A、B、C、E。每日，qd.；每日4次，qid.；每4小时，q4h；每晚，qn.

解析：本题考查处方中常见的外文缩写及其含义。“每日”的缩写是“qd.”（A对），“每日四次”的缩写是“qid.”（B对），“每4小时”的缩写是“q4h”（C对），“每晚”的缩写是“qn.”（E对），而“隔日一次”的缩写是“qod.”（D错）。